脐带感染导致婴幼儿上颌骨骨髓炎的感染来源属于
A. 牙源性
B. 血源性
C. 损伤性
D. 腺源性
E. 医源性

正确答案：B。血源性

解析：本题考查新生儿上颌骨骨髓炎的感染来源。新生儿上颌骨骨髓炎主要是血源性感染（B对）。口腔颌面部感染中，牙源性（A错）是病原菌通过病变牙或牙周组织进入人体发生的感染。损伤性感染（C错）是继发于损伤后发生的感染。腺源性感染（D错）常见于口腔、上呼吸道感染继发淋巴结感染，引起筋膜间隙的蜂窝织炎。医源性感染（E错）常见于局麻、手术、穿刺等操作未严格遵守无菌技术造成继发性感染。